患者，男，45岁。咳嗽、咳痰5年，近3年每年持续咳嗽、咳痰3～4个月。肺部X线检查仅见肺纹理增粗。其诊断是
A. 肺结核
B. 支气管哮喘
C. 慢性支气管炎
D. 肺脓肿
E. 支气管扩张

正确答案：C。慢性支气管炎

解析：患者中年男性，咳嗽、咳痰5年，近3年每年持续咳嗽、咳痰3～4个月，肺部X线检查仅见肺纹理增粗，患者临床表现及X线检查与慢性支气管炎相符，故患者最可能的诊断是慢性支气管炎（C对）。肺结核主要表现为乏力、低热、盗汗等结核分枝杆菌中毒症状（A错）。支气管哮喘主要表现为发作性伴有哮鸣音的呼气性呼吸困难（B错）。肺脓肿主要表现为咳嗽、咳黏液痰或黏液脓性痰（D错）。支气管扩张主要表现为反复咳嗽、咳痰或咳脓痰，X线表现为显著扩张的囊状支气管囊腔（E错）。